《中国防治慢性病中长期规划（2017-2025年）》中，为有效控制慢性病疾病负担提出了以下策略，除外
A. 加强健康教育
B. 实施早诊早治
C. 促进医防协同
D. 强化规范诊疗
E. 实行免费就医

正确答案：E。实行免费就医